下列红外吸收光谱的特征吸收的峰位（cm⁻¹）中，属于氨基伸缩振动的是
A. 3750～3000
B. 3000～2700
C. 2400～2100
D. 1900～1650
E. 1000～650

正确答案：A。3750～3000

解析：本题考查红外吸收光谱。羟基和氨基的伸缩振动特征吸收峰为3750～3000cm⁻¹（A对）。3000～2700cm⁻¹（B错）为烷基和醛基的特征吸收峰。2400～2100cm⁻¹（C错）为C≡C和C≡N的特殊吸收峰。1900～1650cm⁻¹（D错）是醛、酮、羧基及其衍生物的特殊吸收峰。1000～650cm⁻¹（E错）是不同取代形式双键、苯环的特殊吸收峰。